脂肪性基质的栓剂的融变时限规定是
A. 15min
B. 30min
C. 45min
D. 60min
E. 120min

正确答案：B。30min

解析：本题考查栓剂。脂肪性基质的栓剂的融变时限为30min（B对）；水溶性基质的栓剂融变时限为60min（D错）。